男，80岁。高血压病史10余年，长期服用钙通道阻滞剂，1个月前因血压控制不满意加用美托洛尔25mgbid，近1周觉乏力、倦怠、间断黑朦。查体：BP110/70mmHg，心率50次/分，心律不齐，各瓣膜听诊区未闻及杂音。心电图所示PR间期逐渐延长直至QRS波群脱落，最恰当的处理是
A. 将美托洛尔调整为25mgqd
B. 将美托洛尔调整为12.5mgbid
C. 植入永久起搏器
D. 停用美托洛尔
E. 将美托洛尔更换为地尔硫䓬30mgtid

正确答案：B。将美托洛尔调整为12.5mgbid

解析：老年高血压男性患者，长期服用钙通道阻滞剂，因血压控制不满意加用β受体拮抗剂，近期出现乏力、倦怠、间断黑朦等症状。查体：血压BP110/70mmHg（下降明显，正常80岁以上高龄老年人降压的目标值为＜150/90mmHg），心率50次/分（明显减慢，正常60～100次/分），心律不齐。心电图所示PR间期逐渐延长直至QRS波群脱落（二度Ⅰ型房室阻滞典型心电图表现）。结合患者年龄、病史、服药史临床表现、体征及检查，考虑为二度Ⅰ型房室阻滞。β受体拮抗剂对心肌缩力、窦房结及房室结功能均有抑制作用，并可增加气道阻力，因此，患者出现上述症状为加用美托洛尔所致，美托洛尔不能立即停药，应该逐渐减量（B对）。